对于掌深弓描述正确的是
A. 由桡动脉掌深支和尺动脉末端组成
B. 位于指浅屈肌腱深面
C. 由桡、尺动脉木端组成
D. 由尺动脉掌深支和桡动脉末端组成
E. 由桡动脉掌深支和尺动脉掌深支组成

正确答案：D。由尺动脉掌深支和桡动脉末端组成

解析：由尺动脉掌深支和桡动脉末端组成（D对）掌深弓。掌深弓位于指深屈肌腱（B错）的深面。